急性毛细支气管（喘憋性）肺炎胸部X线特征是
A. 胸部X线有不同程度的梗阻性肺气肿
B. 胸部X线可见小片浸润影，小脓肿或肺大泡
C. 胸部X线显示絮状斑片影，阴影可于短时间内消失
D. 胸部X线检查未见主要病变
E. 胸部X线检查肺门阴影增大

正确答案：A。胸部X线有不同程度的梗阻性肺气肿

解析：急性毛细支气管肺炎是由多种致病原感染引起的急性毛细支气管炎症，以喘憋、三凹征和喘鸣为主要临床特点，由于细支气管阻塞后，肺泡气体增多，故可形成肺气肿征象，从而胸部X线有不同程度的梗阻性肺气肿（A对）。胸部X线可见小片浸润影，小脓肿或肺大泡（B错）常见于COPD患者合并感染。胸部X线显示絮状斑片影，阴影可于短时间内消失（C错）常见于大叶性肺炎。胸部X线检查未见主要病变（D错）常见于正常人或肺部病变不明显者。胸部X线检查肺门阴影增大（E错）可见于中央型肺癌等。